药物和生物大分子作用时，可逆的结合形式有
A. 范德华力
B. 共价键
C. 电荷转移复合物
D. 偶极-偶极相互作用力
E. 氢键

正确答案：A、C、D、E。范德华力；电荷转移复合物；偶极-偶极相互作用力；氢键

解析：本题考查药物与生物大分子相互作用的方式。药物在和生物大分子作用时一般以键合的形式结合。键合类型包括共价键和非共价键。非共价键是可逆的结合形式，包括：范德华力（A对）、电荷转移复合物（C对）、离子-偶极和偶极-偶极相互作用力（D对）、氢键（E对）、离子型、疏水性相互作用等。共价键（B错）是不可逆的结合形式。